γδT细胞主要分布于
A. 皮肤
B. 心脏
C. 脾脏
D. 肝脏
E. 肾脏

正确答案：A。皮肤

解析：γδT细胞：γδT细胞主要分布于皮肤和黏膜组织，其TCR缺乏多样性，只能识别由CD1分子提呈的糖脂、病毒糖蛋白、分枝杆菌的磷酸糖和热休克蛋白（HSP）等，无MHC限制性。γδT细胞可杀伤病毒或细胞内细菌感染的靶细胞、异常表达CD1分子的靶细胞以及某些肿瘤细胞。γδT细胞表达NKG2D。掌握“T淋巴细胞”知识点。